某药的稳态血药浓度3mg/L，表观分布容积为2.0L/Kg。若患者体重为60Kg，静脉滴注该药到达稳态时，体内的稳态药量是
A. 30mg
B. 60mg
C. 120mg
D. 180mg
E. 360mg

正确答案：E。360mg

解析：本题考查表观分布容积。已知Css=3mg/L和V=2.0L/kg，达到稳态血药浓度，此时药物的消除速度等于输出速度，根据表观分布容积公式X=VC，代入可得X=2×60×3=360mg（E对）。